引起流行性脑脊髓膜炎的脑膜炎球菌的特点不包括
A. 在体外易自溶而亡
B. 革兰染色阳性
C. 多数由A、B、C群引起
D. 包括13个血清群
E. 奈瑟球菌

正确答案：B。革兰染色阳性

解析：脑膜炎奈瑟菌是流行性脑脊髓膜炎（流脑）的病原菌（E对），为一群革兰染色阴性球菌（B错，为本题正确答案）。培养时对营养要求较高，在体外易产生自溶酶自溶而亡（A对）。目前根据荚膜多糖群特异性抗原分为13个血清群，疾病多数由A、B、C群引起（CD对）。